因华法林抗凝血作用起效滞后，需联合应用
A. 西酞普兰
B. 依诺肝素
C. 雷尼替丁
D. 阿司匹林
E. 维生素K

正确答案：B。依诺肝素

解析：本题考查药物的相互作用。因华法林抗凝血作用起效滞后，需联合应用依诺肝素（B对）。口服华法林起抗凝作用至少3天，而依诺肝素起效时间短。西酞普兰（A错）为抗抑郁药。雷尼替丁（C错）为抑制胃酸分泌药物。阿司匹林（D错）与华法林合用，抗凝作用并不优于单独使用，出血的危险反而明显增加。维生素K（E错）能促进血液凝固，能够拮抗华法林的作用。